属叶酸类抗代谢物的药物是
A. 甲氨蝶呤
B. 巯嘌呤
C. 吉西他滨
D. 长春瑞滨
E. 卡莫氟

正确答案：A。甲氨蝶呤

解析：本题考查叶酸拮抗剂类抗肿瘤药。甲氨蝶呤（A对）属于叶酸类抗代谢药，为二氢叶酸还原酶抑制剂。巯嘌呤（B错）为嘌呤类抗代谢药。吉西他滨（C错）为二氟核苷类抗代谢物抗癌药。长春瑞滨（D错）为长春碱类抗肿瘤药。卡莫氟（E错）属嘧啶类抗代谢药。